下列哪种氨基酸可转变成烟酸
A. 苏氨酸
B. 脯氨酸
C. 酪氨酸
D. 色氨酸
E. 亮氨酸

正确答案：D。色氨酸